下述疾病中，哪项不是衣原体引起的
A. 大叶性肺炎
B. 非淋菌性泌尿生殖道感染
C. 沙眼
D. 性病淋巴肉芽肿
E. 急性呼吸道感染

正确答案：A。大叶性肺炎